关于大隐静脉的描述，正确的是
A. 起于足背静脉弓外侧
B. 为下肢的深静脉
C. 经内踝前方上行
D. 经内踝后方上行
E. 与小隐静脉无交通

正确答案：C。经内踝前方上行

解析：大隐静脉为下肢的浅静脉（B错），起于足背静脉弓的内侧（A错），经内踝前方上行（C对D错），在腹股沟韧带下穿过卵圆窝注入股总静脉。大隐静脉在膝平面下，分别由前外侧和后内侧分支与小隐静脉交通（E错）。